男，50岁。呕血黑便4小时，发病前曾食硬质食物，发现HBsAg（+）30年，查体：P：108次／分，BP90/60mmHg，烦躁，面色苍白皮肤湿冷应考虑的出血原因是
A. 食管胃底静脉曲张破裂
B. 食管肿瘤
C. 胃溃疡
D. 十二指肠溃疡
E. 急性胃粘膜病变

正确答案：A。食管胃底静脉曲张破裂

解析：患者中老年男性，发现HBsAg（+）30年（提示为慢性乙肝患者，慢性乙肝为肝硬化病因），呕血黑便4小时（上消化道出血典型表现），发病前曾食硬质食物（食管胃底静脉曲张出血诱因），查体：P：108次／分（正常值60～100次/分，略快），BP90/60mmHg（正常值BP90～139/60～89 mmHg，提示患者轻度休克），烦躁，面色苍白皮肤湿冷（典型的休克临床表现），根据患者的病史、临床表现、查体初步诊断为1.肝硬化；2.食管为底静脉曲张出血；3.轻度休克。因此，患者烦躁，面色苍白皮肤湿冷应考虑的出血原因是食管胃底静脉曲张破裂（A对）。食管肿瘤（P351）（B错）患者早期多无明显症状，中晚期随肿瘤增大，会出现进行性咽下困难、食物反流、咽下疼痛，压迫等症状。胃溃疡（P359）（C错）、十二指肠溃疡（D错）患者多有上腹不适或慢性、周期性、节律性疼痛等临床表现。急性胃粘膜病变（P353）（E错）患者常由应激、服用非甾体抗炎药、抗肿瘤化疗药物的等特定药物，饮酒，创伤等病因引起，与该例患者病史不符。